下列各项，不属于月经过少肾虚证临床表现的是
A. 经量渐少，色暗淡，质稀
B. 头晕耳鸣，腰膝酸软
C. 头晕目眩，胸胁胀满
D. 舌质淡，脉沉弱
E. 小腹冷，夜尿多

正确答案：C。头晕目眩，胸胁胀满

解析：头晕目眩，胸胁胀满可能为肝郁脾虚证的表现，不是月经过少肾虚证的表现（C对）。禀赋素弱或后天伤肾，肾气亏虚，精血不足，冲任血海亏虚以致经量素少或渐少，肾阳虚，血不化赤，则经色黯淡，质薄（A错）。肾虚则腰膝酸软，足跟痛，精亏血少，脑髓不充，故头晕耳鸣（B错）。胞系于肾，肾阳不足，胞失温煦，故小腹冷，肾虚膀胱之气不固，故夜尿多（E错）。舌淡，脉沉弱或沉迟亦为肾气不足之象（D错）。